女，26岁。已婚，突发腹痛，阴道流血1天，血压60/40mmhg，体检发现一侧下腹部持续剧烈疼痛，阴道后穹窿穿刺抽出不凝血。最有价值的体征是
A. 一侧下腹部持续性剧烈疼痛
B. 阴道后穹窿穿刺抽出不凝血
C. 突发腹痛
D. 阴道流血1天
E. 血压60/40mmHg

正确答案：B。阴道后穹窿穿刺抽出不凝血

解析：育龄期已婚女性，突发腹痛，阴道流血1天（输卵管妊娠的典型症状为停经后腹痛与阴道流血），血压60/40mmHg（重度休克收缩压＜70mmHg，当腹腔出血较多时，可出现面色苍白，脉搏快而细弱、心率增快和血压下降等休克表现），体检一侧下腹部持续剧烈疼痛（输卵管妊娠破裂时突感一侧下腹部撕裂样疼痛），阴道后穹窿穿刺抽出不凝血（阴道后穹窿穿刺是异位妊娠破裂的一种简单可靠的诊断方法，适用于疑有腹腔内出血的患者），应首先考虑异位妊娠破裂，最有价值的体征是阴道后穹窿穿刺抽出不凝血（B对）。一侧下腹部持续性剧烈疼痛（A错）、突发腹痛（C错）、阴道流血1天（D错）、血压60/40mmHg（E错）对异位妊娠破裂的诊断均无特异性。